用电喷雾电离或电子轰击电离等技术测定分子量的谱学技术是
A. 红外光谱
B. 高效液相色谱
C. 质谱
D. 核磁共振谱
E. 紫外-可见吸收光谱

正确答案：C。质谱

解析：本题考查的是质谱。用电喷雾电离或电子轰击电离等技术测定分子量的谱学技术是质谱（C对）。质谱（MS）：可用于确定分子量及求算分子式和提供其他结构信息。质谱的电离技术发展较快，软电离成为当今质谱仪器的标配，例如，电喷雾电离（简称ESI）、大气压化学电离（APCI）、化学电离（简称CI）、场致电离（简称FI）、场解析电离（简称FD）、快速原子轰击电离（简称FAB）等，极大地拓宽了质谱的检测范围，对热不稳定的化合物的研究提供了新的技术。红外光谱（A错）：分子中价键的伸缩及弯曲振动将在光的红外区域，即4000～400cm⁻¹处引起吸收。测得的吸收图谱叫红外光谱（IR）。红外光谱主要用于鉴别分子中的特征官能团，某些情况下，IR光谱可用于区别芳环的取代方式、构型及构象等。高效液相色谱（B错）（HPLC）：是判断有效成分纯度的一种重要方法，具有样品用量小、操作时间快、灵敏度高和准确等优点。该方法发展迅速，同时具有分离和分析鉴定的用途，已成为中药化学的常规分析方法。核磁共振谱（D错）：①氢核磁共振（¹H-NMR）：¹H-NMR测定中通过化学位移（δ）、谱线的积分面积以及裂分情况（重峰数及偶合常数J）可以提供分子中质子的类型、数目及相邻原子或原子团的信息，对中药化学成分的结构测定具有十分重要的意义。②碳核磁共振（¹³C-NMR）：与¹H-NMR一样，¹³C的信号化学位移也取决于周围的化学环境及电子密度，并可据此判断¹³C的类型。显然，改变某个¹³C核周围的化学环境或电子密度，如引入某个取代基，则该¹³C信号即可能发生位移（取代基位移）。位移的方向（高场或低场）及幅度已经累积了一定经验规律。常见的有苯的取代基位移、羟基的苷化位移和酰化位移等，在结构研究中均具有重要的作用。紫外-可见吸收光谱（E错）：对于分子中含有共轭双键、α，β-不饱和羰基（醛、酮、酸、酯）结构的化合物以及芳香化合物的结构鉴定来说是一种重要的手段，通常主要用于推断化合物的骨架类型，还可用于测定化合物的精细结构。